正常人呼吸与脉搏之比为
A. 1比1
B. 1比2
C. 1比3
D. 1比4
E. 1比5

正确答案：D。1比4

解析：正常成人呼吸为12～20次/分，脉搏为60～100次/分，呼吸与脉搏之比为1：4（D对）。